对因功效是指某些中药能针对病因起治疗作用，具体包括祛邪、扶正、调理脏腑功能，消除病理产物等。其中不属于扶正功效的是
A. 补气
B. 助阳
C. 活血
D. 养血
E. 滋阴

正确答案：C。活血

解析：本题考查的是中药功效的分类。对因功效是指某些中药能针对病因起治疗作用，具体包括祛邪、扶正、调理脏腑功能、消除病理产物等。其中不属于扶正功效的是活血（C错，为本题正确答案）。中药功效按对因功效分类：对因功效，是指某些中药能针对病因起治疗作用。具体包含祛邪、扶正、调理脏腑功效、消除病理产物等。其中，属于祛邪功效的有祛风、散寒、除湿、清热、泻下、涌吐、解毒、杀虫等；属于扶正功效的有补气（A对）、助阳（B对）、滋阴（E对）、养血（D对）等；属于调理脏腑或气血功效的有疏肝、柔肝、宣肺、和中、理气、活血、安神、开窍、潜阳、息风等；属于消除病理产物功效的有消食、利水、祛痰、化瘀、排石、排脓等。